换药时应用棉球清洁的正确动作是
A. 揩
B. 擦
C. 蘸
D. 涂
E. 蹭

正确答案：C。蘸

解析：换药的动作要准确、轻巧、细致，切忌粗暴。应用棉球清洁暴露创面时是“蘸”而不是“揩”、“擦”的动作。掌握“口外创口处理”知识点。